翼下颌注射法又称
A. 上牙槽后神经阻滞麻醉
B. 眶下神经阻滞麻醉
C. 腭前神经阻滞麻醉
D. 鼻腭神经阻滞麻醉
E. 下牙槽神经阻滞麻醉

正确答案：E。下牙槽神经阻滞麻醉

解析：下牙槽神经阻滞麻醉：下牙槽神经阻滞麻醉是将麻药注射到翼下颌间隙内，故亦称翼下颌注射法。掌握“颌面部常用局麻法及牙拔除的麻醉选择”知识点。